直接接触传染病不包括
A. 痢疾
B. 梅毒
C. 艾滋病
D. 淋病
E. 狂犬病

正确答案：A。痢疾

解析：本题考查直接接触传染病的种类。直接接触传播是指在没有外界因素参与下，易感者与传染源直接接触而导致的疾病传播，如性传播疾病，狂犬病（E对）等。性传播感染主要包括衣原体感染、淋病（D对）、梅毒（B对）和滴虫病以及由乙型肝炎病毒、单纯疱疹病毒、人类免疫缺陷病毒（C对）和人乳头状瘤病毒引起的感染。痢疾（A错，为本题正确答案）不是直接接触传染病。